小儿干咳无痰，多为
A. 外感风寒
B. 肺蕴痰热
C. 外感风热
D. 痰浊阻肺
E. 肺燥阴伤

正确答案：E。肺燥阴伤

解析：燥邪犯肺，肺阴受损，故干咳无痰或痰少黏稠（E对）。咳声清高，伴流清涕，多为外感风寒（A错）。咳嗽频频，痰稠难咳，喉中痰鸣，多为肺蕴痰热（B错）。咳声重浊，鼻塞声重，痰稠色黄，多为外感风热（C错）。咳嗽痰多，易于咳出，多因痰浊阻肺所致（D错）。